维生素B₁₂或叶酸缺乏引起贫血是
A. 溶血性贫血
B. 失血性贫血
C. 巨幼细胞贫血
D. 缺铁性贫血
E. 再生障碍性贫血

正确答案：C。巨幼细胞贫血

解析：叶酸缺乏症的主要表现为巨幼红细胞性贫血，其他如舌炎、舌痛、舌乳头萎缩、舌面光滑、口角炎及食欲减退等。严重的维生素B12缺乏可导致巨幼红细胞贫血和不可逆的中枢神经脱髓鞘损害（C对）。溶血性贫血的根本原因是红细胞寿命缩短。造成红细胞破坏加速的原因可概括分为红细胞本身的内在缺陷和红细胞外部因素异常。前者多为遗传性溶血，后者引起获得性溶血（A错）。失血性贫血是指由于各种急性或慢性失血导致血液中的红细胞丢失过多、超过骨髓的代偿能力（B错）。当机体对铁的需求与供给失衡，导致体内贮存铁耗尽，继之红细胞内铁缺乏，最终引起缺铁性贫血（D错）。再生障碍性贫血简称再障，是一组由多种病因所致的骨髓造血功能衰竭性综合征，以骨髓造血细胞增生减低和外周血全血细胞减少为特征（E错）。